在儿童感染病毒性疾病使用阿司匹林退热时，偶可引起肝衰竭合并脑病，称为
A. 揭皮试验养性
B. 中毒性表皮坏死综合征
C. 胆脂肪变性—脑病综合征
D. 舍格伦综合征
E. 瑞夷综合征

正确答案：E。瑞夷综合征

解析：在儿童感染病毒性疾病使用阿司匹林退热时，偶可引起急性肝脂肪变性—脑病综合征（瑞夷综合征），以肝衰竭合并脑病为突出表现，预后恶劣。掌握“阿司匹林”知识点。